流行性出血热皮肤出血改变是
A. 斑丘疹
B. 玫瑰疹
C. 搔抓样瘀点
D. 红斑疹
E. 皮肤坏死

正确答案：C。搔抓样瘀点

解析：流行性出血热皮肤出血改变为搔抓样瘀点（C对）流行性出血热发病2～3天软腭充血明显，腋下、上胸部、颈及肩部等皮肤有散在、簇状或搔抓状、条索样出血点，少数患者有鼻衄、咯血、黑便等。如皮肤迅速出现大片瘀斑或腔道出血，提示病情严重，可能并发弥漫性血管内凝血。斑丘疹（A错）多见于风疹、猩红热、湿疹及药物疹等。玫瑰疹（B错）为伤寒患者在极期出现典型临床表现，半数患者在病程第7～14天皮肤出现淡红色斑丘瘆，称为玫瑰疹，直径约2～4mm，压之退色，多在10个以下，分批出现，主要分布于胸、腹及肩背部，四肢少见，常于2～4天内变淡、消失。红斑疹（D错）多见于过敏性湿疹，主要是因为过敏性体质受到过敏源刺激，进而引起皮肤发炎的反应。皮肤坏死（E错）为流行性脑脊髓膜炎皮肤严重出血的改变。